不传染人的畜病是
A. 炭疽
B. 猪瘟
C. 结核
D. 口蹄疫
E. 布氏杆菌病

正确答案：B。猪瘟